对于无症状的室性期前收缩患者采取的治疗措施
A. 定期复查
B. 去除诱因和病因
C. 每日服用β受体阻滞剂
D. 手术射频
E. 冠脉支架治疗

正确答案：B。去除诱因和病因

解析：室性期前收缩是一种最常见的心律失常，正常人与各种心脏病患者均可发生，正常人发生室性期前收缩的机会随年龄的增长而增加。常见于高血压、冠心病、心肌病、风湿性心肌病与二尖瓣脱垂患者。对于无症状的室性期前收缩，患者一般并无器质性心脏病，且室性期前收缩并不会增加此类患者发生心脏病死亡的危险性，此时无需药物治疗（C错），采取去除诱因和病因（B对）的治疗措施即可，包括避免诱发因素如吸烟、咖啡、应激等，也可嘱咐患者定期复查（A错），观察病情变化。手术射频（D错）主要用于治疗快速性心律失常，如房性心律失常及房室折返性心律失常。冠脉支架治疗（E错）用于治疗合并冠状动脉严重狭窄的病人。